定性研究常用的方法有
A. 观察法和深入访谈法
B. 现况调查
C. 专题小组讨论
D. A和C
E. A和B

正确答案：D。A和C